可导致视神经炎和血尿酸升高的药物是
A. 乙胺丁醇
B. 利福平
C. 对氨基水杨酸
D. 吡嗪酰胺
E. 异烟肼

正确答案：A。乙胺丁醇

解析：本题考查药物的不良反应。可导致视神经炎和血尿酸升高的药物是乙胺丁醇（A对）。乙胺丁醇常见不良反应有球后视神经炎、胃肠道反应。过敏反应发生率较少，表现为畏寒、关节肿痛（尤其大趾、髁、膝关节）、病变关节表面皮肤发热拉紧感（急性痛风、高尿酸血症）；少见皮疹、发热、关节痛，或麻木、针刺感、烧灼痛或手足软弱无力（周围神经炎）。利福平（B错）不良反应常见有消化道反应、肝毒性、类流感样综合征等。对氨基水杨酸（C错）常见胃肠道反应，也可引起皮疹、发热、关节痛、白细胞减少症和肝肾损害等。吡嗪酰胺（D错）不良反应有常见肝脏损害，如血清转氨酶升高，甚或出现黄疸。异烟肼（E错）的不良反应有肝脏毒性、神经系统毒性、变态反应等。